药品调剂人员在调配存在“十八反”“十九畏”的中药饮片处方时，应采取措施是
A. 作为不合法处方，拒绝调配，并按照有关规定报告
B. 告知处方医师，并请其确认和签字后，方可调剂
C. 经主管中药师以上专业技术人员复核签字后，方可调剂
D. 对患者进行用药指导，在患者充分知情，并请其签字确认后，方可调剂

正确答案：B。告知处方医师，并请其确认和签字后，方可调剂

解析：本题考查医院中药饮片调剂与临方炮制。药品调剂人员在调配存在“十八反”“十九畏”的中药饮片处方时，应采取措施是告知处方医师，并请其确认和签字后，方可调剂（B对）。医院中药饮片调剂与临方炮制：医院对中药饮片调剂和临方炮制要符合国家有关规定。中药饮片调剂室应当有与调剂量相适应的面积，配备通风、调温、调湿、防潮、防虫、防鼠、除尘设施，工作场地、操作台面应当保持清洁卫生。中药饮片调剂室的药斗等储存中药饮片的容器应当排列合理，有品名标签。药品名称应当符合《中华人民共和国药典》或省、自治区、直辖市药品监督管理部门制定的规范名称。标签和药品要相符。中药饮片装斗时要清斗，认真核对，装量适当，不得错斗、串斗。医院调剂用计量器具应当按照质量技术监督部门的规定定期校验，不合格的不得使用。中药饮片调剂人员在调配处方时，应当按照《处方管理办法》和中药饮片调剂规程的有关规定进行审方和调剂。对存在“十八反”“十九畏”、妊娠禁忌、超过常用剂量等可能引起用药安全问题的处方，应当由处方医生确认（“双签字”）或重新开具处方后方可调配。中药饮片调配后，必须经复核后方可发出。二级以上医院应当由主管中药师以上专业技术人员负责调剂复核工作，复核率应当达到100%。医院应当定期对中药饮片调剂质量进行抽查并记录检查结果。中药饮片调配每剂重量误差应当在±5%以内。罂粟壳不得单方发药，必须凭有麻醉药处方权的执业医师签名的淡红色处方方可调配，每张处方不得超过三日用量，连续使用不得超过七天，成人一次的常用量为每天3～6克。处方保存三年备查。医院进行临方炮制，应当具备与之相适应的条件和设施，严格遵照国家药品标准和省（区、市）药品监督管理部门制定的炮制规范炮制，并填写“饮片炮制加工及验收记录”，经医院质量检验合格后方可投入临床使用。